初产妇，28岁。在家中自然分娩后15天，阴道多量流血1天。无寒战、高热。查体：T37℃，P80次/分，R18次/分，BP90/60mmHg，子宫如妊娠3个月大，质软，压痛不明显，宫口松，能容2指。其阴道流血最可能的原因是
A. 胎盘、胎膜残留
B. 子宫颈裂伤
C. 子宫内膜炎
D. 子宫脱垂
E. 子宫肌炎

正确答案：A。胎盘、胎膜残留

解析：初产妇，28岁。在家中自然分娩后15天，阴道多量流血1天。无寒战、高热。查体：T37℃。综合患者的症状、体征，初步诊断为胎盘、胎膜残留（A对）。子宫颈裂伤（B错）表现为胎儿娩出后立即发生阴道流血，色鲜红。患者体温正常，可排除子宫内膜炎（C错）。子宫脱垂（D错）表现为腹部下坠，伴有膀胱膨出时，可出现排尿困难、尿潴留、压力性尿失禁等。